苯妥英钠轻度中毒的表现为
A. 昏迷不醒、反射消失
B. 面肌痉挛、言语不清
C. 腹泻、口干、心动过速
D. 瞳孔缩小、视力模糊
E. 眩晕、手颤、全身乏力

正确答案：E。眩晕、手颤、全身乏力

解析：本题考查苯妥英钠。苯妥英钠轻度中毒的表现为眩晕、手颤、全身乏力（E对）。苯妥英钠治疗血浆浓度为10-20µg/ml，超过40㎍/ml会出现严重不良反应，如嗜睡、昏迷（A错）；轻度中毒表现为眩晕、手颤、全身乏力、心慌（C错）、震颤、看东西模糊（D错）、说话不清楚等（B错）。